下列哪些青霉素类药物能耐青霉素酶
A. 氨苄青霉素
B. 苯唑青霉素（新青霉素Ⅱ）
C. 苄星霉素G
D. 乙氧萘青霉素（新青霉素Ⅲ）
E. 邻氯唑青霉素

正确答案：B、D、E。苯唑青霉素（新青霉素Ⅱ）；乙氧萘青霉素（新青霉素Ⅲ）；邻氯唑青霉素

解析：本题考查青霉素。苯唑西林又称苯唑青霉素（新青霉素Ⅱ）（B对）、乙氧萘青霉素（新青霉素Ⅲ）（D对）和氯唑西林又称邻氯唑青霉素（E对）为耐青霉素酶青霉素类。苄星霉素G（C错）即青霉素G，易被β-内酰胺酶水解破坏，性质不稳定。氨苄西林即氨苄青霉素（A错）不耐酶。